经坐骨小孔进入坐骨肛门窝
A. 臀上动脉
B. 臀下动脉
C. 阴部内动脉
D. 闭孔动脉
E. 异常闭孔动脉

正确答案：C。阴部内动脉

解析：阴部内动脉（C对）经坐骨小孔进入坐骨肛门窝，发出肛动脉、会阴动脉和阴茎背动脉（阴蒂背动脉），分布于肛门、会阴部和外生殖器。